中枢性面瘫（核上瘫）下述哪种症状不会出现
A. 病灶对侧额纹消失
B. 病灶对侧鼻唇沟消失
C. 病灶对侧口角低垂
D. 口角歪向病灶侧
E. 病灶对侧不能作露齿动作

正确答案：A。病灶对侧额纹消失

解析：中枢性面瘫（核上瘫）会造成病灶对侧鼻唇沟消失（B对），病灶对侧口角低垂（C对），口角歪向病灶侧（D对），病灶对侧不能作露齿动作（E对）。病灶对侧额纹消失为核下瘫的表现（A错，为本题正确选项）。